完全性葡萄胎的恶变率，国内外报道有异，我国为
A. 10.5%
B. 14.5%
C. 20.5%
D. 30.5%
E. 35%

正确答案：B。14.5%

解析：完全性葡萄胎的恶变率，国内外报道有异，我国为0.145（B对）。